HBV处于复制状态，有传染性的标志是
A. 抗-HBe(+)
B. HBeAg(+)
C. 抗-HBs(+)
D. HBsAg(+)
E. 抗-HBc(+)

正确答案：B。HBeAg(+)

解析：HBeAg(+)表示HBV处于复制状态，有传染性，患者处于高感染低应答期（B对）。抗-HBe(+)表示HBV复制多处于静止状态（A错）。抗-HBs(+)表示对HBV有免疫力（C错）HbsAg阳性反应现症HBV感染，阴性不能排除HBV感染（D错）。抗-HBc(+)表示HBV现症感染或既往感染（E错）。